患者，男，55岁，诊断为良性前列腺增生症，服用非那雄胺片治疗，最有可能发生的与用药相关的不良反应是
A. 体位性低血压
B. 心悸
C. 性欲减退
D. 脱发
E. 血压升高

正确答案：C。性欲减退

解析：本题考查非那雄胺的不良反应。患者，男，55岁，诊断为良性前列腺增生症，服用非那雄胺片治疗，最有可能发生的与用药相关的不良反应是性欲减退（C对）。非那雄胺是5α还原酶抑制剂，常见不良反应有性欲下降及射精量减少等。